中药饮片贮存中常见的质量变异现象有
A. 虫蛀
B. 霉变
C. 泛油
D. 酸败
E. 沉淀

正确答案：A、B、C。虫蛀；霉变；泛油

解析：本题考查的是中药饮片贮存中常见的质量变异现象。中药饮片贮存中常见的质量变异现象有虫蛀（A对）、霉变（B对）与泛油（C对）。中药饮片贮存中常见的质量变异现象：虫蛀、霉变、泛油、变色、气味散失、风化、潮解、粘连、腐烂。酸败（D错）与沉淀（E错）属于中成药贮存中常见的质量变异现象。中成药贮存中常见的质量变异现象有：虫蛀、霉变、酸败、挥发、沉淀。